对β₂受体有选择性激动作用的平嘴药是
A. 茶碱
B. 肾上腺素
C. 沙丁胶醇
D. 色甘酸钠
E. 异丙肾上腺素

正确答案：C。沙丁胶醇